患者，女，33岁。平素易生闷气，经行期乳房胀痛明显，此次妊娠后觉小腹胀痛不适，情志不畅，嗳气叹息，夜寐、食欲不佳，舌红，苔薄黄，脉弦滑。其证型为
A. 血虚证
B. 血瘀证
C. 血热证
D. 气滞证
E. 虚寒证

正确答案：D。气滞证

解析：该患者以妊娠后小腹胀痛不适为主要症状，故辨病为妊娠腹痛；其平素易生闷气，经行期乳房胀痛明显，伴有情志不畅，嗳气叹息，夜寐、食欲不佳，舌红，苔薄黄，脉弦滑等症状，辨证为气滞证（D对）。肝之经脉绕阴器，至少腹，上贯膈布胁肋。患者平素易生闷气，孕后肝血偏虚，肝失调达，气机不畅，胞脉气血阻滞，故小腹胀痛不适；情志抑郁，嗳气叹息，苔薄黄，脉弦滑均为气郁之征。